休克指数的计算方法是
A. 收缩压和舒张压之比
B. 心率与收缩压之比
C. 脉率与舒张压之比
D. 脉率与脉压之比
E. 脉率与收缩压之比

正确答案：E。脉率与收缩压之比

解析：休克指数的计算方法是脉率与收缩压之比（E对），可帮助判定休克的有无即轻重。指数为0.5多提示无休克；＞1.0～1.5提示有休克；＞2.0为严重休克。